男，35岁，餐后半小时出现上腹饱胀，疼痛3年，平素常有反酸、嗳气，偶有黑便。10小时前呕鲜血，约500ml，查体：T36.5℃，P110次/分，R18次/分，BP120/80mmHg。双肺呼吸音清，未闻及干湿性啰音，心率110次/分，律齐，腹软，无压痛，血常规：Hb95G/L，WBC15.6×10⁹/L，N0.86，Plt120×10⁹/L，胃镜检查：胃体小弯侧直径1cm溃疡，边缘光滑，溃疡底部有小血管搏动性出血，内镜下止血失败，该患者手术治疗首选的术式为
A. 毕Ⅱ氏胃大部切除术
B. 选择性迷走神经切断术
C. 毕Ⅰ式胃大部切除术
D. 全胃切除术
E. 高选择性迷走神经切断术

正确答案：C。毕Ⅰ式胃大部切除术

解析：患者反酸、嗳气，偶有黑便，餐后半小时出现上腹饱胀，疼痛（餐后痛，胃溃疡特征）。10小时前呕鲜血，约500ml（胃溃疡大出血），胃体小弯侧溃疡，溃疡底部有出血，内镜下止血失败，应行胃大部切除术。该患者为胃溃疡大出血，因此首选的术式为毕Ⅰ式胃大部切除术（C对）。毕Ⅰ式是胃与十二指肠吻合，多用于胃溃疡。毕Ⅱ氏胃大部切除术（A错）为十二指肠断端缝闭，胃和空肠吻合，又分为结肠前和结肠后方式，多用于十二指肠溃疡。全胃切除术（D错）用于胃癌。选择性迷走神经切断术（BE错）现已很少用。